男，65岁，心房颤动及高血压病史5年，糖尿病2年，1年前曾发作言语不利伴肢体活动障碍，该患者长期抗栓治疗的药物应是
A. 低分子肝素
B. 华法林
C. 潘生丁
D. 氯吡格雷
E. 阿司匹林

正确答案：B。华法林

解析：老年男性患者，心房颤动及高血压病史5年，糖尿病2年，1年前曾发作言语不利伴肢体活动障碍，血栓栓塞的危险度较高，华法林是香豆素类抗凝剂，起效后作用和维持时间亦较长，该患者长期抗栓治疗的药物应是华法林（B对）。低分子肝素（A错）长期应用不良反应较多，如出血、血小板减少症、过敏反应等。潘生丁（C错）已基本停产。氯吡格雷（D错）、阿司匹林（E错）是血小板聚集抑制剂，不适用于长期抗栓治疗。